治心肾不交之虚烦不眠宜用
A. 乌梅
B. 赤石脂
C. 桑螵蛸
D. 莲子肉
E. 乌贼骨

正确答案：D。莲子肉

解析：本题考查的是莲子肉的主治病证。治心肾不交之虚烦不眠宜用莲子肉（D对）。莲子肉：【主治病证】（1）脾虚久泻、食欲不振。（2）肾虚遗精、滑精，脾肾两虚之带下。（3）心肾不交之虚烦、惊悸失眠。乌梅（A错）：【主治病证】（1）肺虚久咳。（2）久泻久痢。（3）虚热消渴。（4）蛔厥腹痛。（5）崩漏，便血。赤石脂（B错）：【主治病证】（1）泻痢不止，便血脱肛。（2）崩漏，赤白带下。（3）湿疮流水，溃疡不敛，外伤出血。桑螵蛸（C错）：【主治病证】（1）肾阳亏虚之遗精、滑精，遗尿、尿频，小便白浊，带下。（2）阳痿不育。乌贼骨（E错）为海螵蛸的别名。海螵蛸：【主治病证】（1）崩漏下血，肺胃出血，创伤出血。（2）肾虚遗精，赤白带下。（3）胃痛吞酸。（4）湿疮湿疹，溃疡不敛。